以下关于诱发体内潜伏的疱疹病毒活化最佳的一项是
A. 紫外线
B. 创伤
C. 感染
D. 妊娠
E. 以上全是

正确答案：E。以上全是

解析：单纯疱疹病毒携带者当机体遇到激发因素如紫外线、创伤、感染、胃肠功能紊乱、妊娠、劳累、情绪、环境等改变时可使体内潜伏的病毒活化，疱疹复发。掌握“口腔单纯疱疹”知识点。